构成心瓣膜的结构
A. 心肌
B. 心外膜
C. 心内膜
D. 浆膜
E. 纤维膜

正确答案：C。心内膜

解析：心内膜（C对）向心腔折叠而形成心瓣膜，是构成心瓣膜的结构。